职业中毒诊断中十分重要的诊断为
A. 社会调查
B. 体格检查
C. 临床症状
D. 职业史
E. 现场调查

正确答案：D。职业史

解析：职业中毒诊断中十分重要的诊断为职业史（D对）。社会调查一般见于水源或食物污染造成的地区流行性中毒（A错）。辅助检查、临床症状一般中毒都需要，不是职业中毒中十分重要的诊断（BC错）。现场调查一般见于食物中毒、CO中毒等（E错）。